右上2腭面龋坏所制备的窝洞类型是
A. Ⅰ类洞
B. Ⅱ类洞
C. Ⅲ类洞
D. Ⅳ类洞
E. V类洞按G.V.Black分类法

正确答案：A。Ⅰ类洞

解析：本题考查银汞充填窝洞的概念。Ⅰ类洞（A对）：为发生于所有牙齿的发育窝、沟内的龋损所制备的窝洞，称为Ⅰ类洞。